同时能刺激多种感官的游戏或运动，叫作
A. 感觉运动训练
B. 体育活动训练
C. 人格发展训练
D. 自制能力训练
E. 感觉整合训练

正确答案：E。感觉整合训练